对阴道有括约作用的是
A. 会阴浅横肌
B. 会阴深横肌
C. 坐骨海绵体肌
D. 尿道阴道括约肌和肛提肌的内侧肌纤维束
E. 肛门外括约肌

正确答案：D。尿道阴道括约肌和肛提肌的内侧肌纤维束

解析：在女性，尿道阴道括约肌可缩紧尿道和阴道，肛提肌和尾骨肌封闭骨盆下口的大部分，有承托盆腔脏器作用。所以对阴道有括约作用的是尿道阴道括约肌和肛提肌的内侧肌纤维束（D对）。